皮肤黏膜淋巴结综合征的中医病因病机是
A. 温邪与气血相搏，侵犯营血
B. 风邪与气血相搏，侵犯营血
C. 素体阳虚，腠理空疏
D. 卫阳不固，外感风寒湿邪
E. 温邪直中脏腑

正确答案：A。温邪与气血相搏，侵犯营血

解析：本病主要是外感温热毒邪，犯于肺卫，蕴于肌腠，侵犯营血所致（A对）。温热毒邪主要从口鼻而入，蕴于肺胃，导致肺胃炽热。邪热上攻咽喉，可见咽血；热毒内迫营血，流注络脉，故手掌、足底潮红；毒入血分，由里出表则出疹；温热毒邪炼液成痰，流注络脉，故淋巴结肿大。温毒之邪，易从火化，伤津耗液，故舌色深绛，状如杨梅，唇红皲裂。目为肝窍，肝火上炎，发为两目红赤。热毒流注经脉而致关节肿痛。热炽营血，血液凝滞，运行不畅，造成血瘀诸症。后期热盛伤津，气血耗损，肢末失养，可见黏膜脱皮，甚至脱甲。